关于链球菌属叙述不恰当的是
A. 革兰氏染色为阳性
B. 直径0.6～1.0μm
C. 呈链状排列
D. 无鞭毛，可形成芽胞
E. 幼龄菌可有透明质酸形成的荚膜

正确答案：D。无鞭毛，可形成芽胞

解析：链球菌属形态和染色：革兰氏染色为阳性，直径0.6～1.0μm，呈链状排列，无鞭毛，不形成芽孢（胞），幼龄菌可有透明质酸形成的荚膜。掌握“链球菌属”知识点。